可致肾素分泌增多的因素是
A. 入球小动脉血压降低
B. 交感神经活动降低
C. 血Na⁺降低
D. 血K⁺升高
E. 致密斑活动降低

正确答案：A。入球小动脉血压降低